下颌神经穿
A. 圆孔
B. 卵圆孔
C. 棘孔
D. 茎乳孔
E. 筛孔

正确答案：B。卵圆孔

解析：下颌神经穿卵圆孔（B对），上颌神经穿圆孔（A错），面神经穿茎乳孔（D错），嗅神经穿筛孔（E错）。